不同体质类型所具有的潜在的相对稳定的倾向性称为
A. 质势
B. 病势
C. 从化
D. 易感性
E. 传变

正确答案：A。质势

解析：不同体质类型所具有的潜在的相对稳定的倾向性称为质势（A对）。人体遭受致病因素的作用时，即在体内产生相应的病机变化，而且不同的致病因素具有不同的病变特点，这种病机变化趋势成为"病势"（B错）。从化，即病情随体质而变化（C错）。传变，指疾病在机体脏腑经络组织中的传移和变化（E错）。